与消化性溃疡关系密切的细菌是
A. 空肠弯曲菌
B. 幽门螺杆菌
C. 伤寒沙门菌
D. 结核分枝杆菌
E. 变形杆菌

正确答案：B。幽门螺杆菌

解析：幽门螺杆菌是螺杆菌属的代表菌种，其与胃窦炎、十二指肠溃疡、胃溃疡、胃腺癌和胃黏膜相关B细胞淋巴瘤的发生关系密切。空肠弯曲杆菌可导致散发性细菌性胃肠炎。伤寒沙门菌可引起肠热症、食物中毒、败血症。结核分枝杆菌可以导致肺结核病。变形杆菌可以促进肾结石和膀胱结石的形成，也可以引起脑膜炎、腹膜炎、败血症和食物中毒等。掌握“流感、百日咳及幽门螺杆菌”知识点。